铅吸收入血后可被转运至全身，主要储存于
A. 肝脏
B. 胃
C. 脂肪组织
D. 血液
E. 骨骼

正确答案：E。骨骼

解析：本题考查铅在体内的代谢。吸收入血的铅大部分与红细胞结合后转运至全身，主要储存于骨骼（E对ABCD错），在肝、肾、脑等组织中亦有一定的分布并产生毒性作用。